一电焊学徒工，无防护条件下电焊操作半天后，次日出现眼痛、流泪、怕光。检查见球结膜充血水肿。致病因素最可能是
A. 红外辐射
B. 紫外线
C. 微波
D. 电离辐射
E. 激光

正确答案：B。紫外线